心源性脑梗死的最主要病因是
A. 心房颤动
B. 感染性心内膜炎
C. 冠心病
D. 心肌梗死
E. 慢性心力衰竭

正确答案：A。心房颤动

解析：心源性脑栓塞的栓子通常来源于心房、心室壁血栓及心脏瓣膜赘生物。导致脑栓塞的病因有：非瓣膜性心房颤动（简称房颤）、风湿性心脏病、急性心肌梗死（CD错）、左心室血栓、充血性心力衰竭（E错）、人工心脏瓣膜、扩张性心肌病及其他较少见的原因，如感染性心内膜炎（B错）、非细菌性血栓性心内膜炎、病态窦房结综合征等。非瓣膜性心房颤动（A对）是心源性脑栓塞最常见的病因，约占心源性脑栓塞50%。栓子主要来源于左心耳。其主要发病机制是房颤导致血流缓慢淤滞，在低剪切率和其他因素作用下激活凝血级联反应，最后形成红细胞－纤维蛋白血栓（红色血栓），导致脑栓塞。